既清肝火，又润肠燥的药是
A. 夏枯草
B. 淡竹叶
C. 决明子
D. 天花粉
E. 龙胆草

正确答案：C。决明子

解析：本题考查的是决明子的性能特点。既清肝火，又润肠燥的药是决明子（C对）。决明子：【性能特点】本品苦微寒清泄，甘益润滑。入肝、肾经，能清肝火、益肾阴而明目，为目赤肿痛及目暗不明之要药。入大肠经，能清热润肠通便，为治热结肠燥便秘之佳品。夏枯草（A错）：【性能特点】本品苦泄辛散寒清，清散兼养，专入肝经，主清肝火、散郁结，兼养血平肝，凡肝火、阳亢及痰核郁结诸疾可选。清肝明目之要药，尤善治血虚肝热之目珠夜痛。淡竹叶（B错）：【性能特点】本品甘淡性寒清利，入心、小肠、膀胱经，能清心除烦、利尿通淋。与竹叶相比，唯以清利，不兼透散；又入膀胱经，利尿通淋力较强，热淋涩痛多用；兼入小肠经，治心火移热于小肠宜用，疗热病烦渴、热淋、水肿兼热及湿热黄疸可投。天花粉（D错）：【性能特点】本品微苦微寒清泄，甘酸益润，清润消溃，入肺、胃经。既清热生津止渴，又润肺燥、清肺热而止咳，还消散肿块、溃疮、促进脓液排出。清热不如石膏，生津不如知母，长于消肿溃脓。因兼酸味而有敛邪之嫌，故温热病不宜早用。龙胆草（E错）的性能特点，2022年考试指南未明确说明。